根据药物的化学结构判断，属于长效的β₂受体激动药的是
A. 沙美特罗
B. 福莫特罗
C. 丙卡特罗
D. 沙丁胺醇
E. 异丙肾上腺素

正确答案：A、B、C。沙美特罗；福莫特罗；丙卡特罗

解析：本题考查长效β₂受体药物。长效β₂受体的药物包括沙美特罗（A对）、福莫特罗（B对）、丙卡特罗（C对）。